关于正常腮腺造影侧位片表现，下列哪种说法不正确
A. 主导管上方约半数人有一个副腺体
B. 儿童的涎腺分支导管显示不明显
C. 老年人涎腺导管的管径可以变宽
D. 除导管系统充盈外，应有少量腺泡充盈
E. 主导管在下颌骨体部斜向后下走行

正确答案：E。主导管在下颌骨体部斜向后下走行

解析：本题考查腮腺造影侧位片的表现。唾液腺造影一般只限于腮腺和下颌下腺，因为腮腺和下颌下腺有较大的导管口可以注射造影剂。在正常腮腺造影侧位片上，儿童腺体及分支导管发育尚不完全，所以腮腺较小，导管较细，主导管显示良好，但细小分支导管显示不明显（B对）。主导管上方约半数人有一个副腺体（A对）。老年人由于管壁张力下降，管径可以变宽（C对）。正常的腮腺注射造影剂后，造影剂可进入主导管附近的腺泡，表现为除导管系统充盈外，应有少量腺泡充盈（D对）。导管口位于上颌第二磨牙相对颊黏膜处，主导管在下颌升支上斜向后下走形（E错，为本题正确答案）。